言脏腑之阴阳，脾为
A. 阴中之阳
B. 阴中之阴
C. 阴中之至阴
D. 阳中之阴
E. 阳中之阳

正确答案：C。阴中之至阴

解析：本题考查脏腑的阴阳属性，属于理解记忆内容。心肺居于上属阳，而心属火，主温通，为阳中之阳（E错）；肺属金，主肃降，为阳中之阴（D错）。肝、脾、肾居下属阴，而肝属木，主升发，为阴中之阳（A错）；肾属水，主闭藏，为阴中之阴（B错）；脾属土，居中焦，为阴中之至阴（C对）。